稳定旁路途径C3转化酶的是
A. S蛋白
B. IgM与抗原结合形成的复合物
C. P因子
D. MBL
E. DAF

正确答案：C。P因子